青蒿素结构中含有
A. 羧基
B. 羟基
C. 过氧基团
D. 内酯
E. 羟甲基

正确答案：C、D。过氧基团；内酯

解析：本题考查的是青蒿素的结构。过氧基团（C对）与内酯（D对）。单环倍半萜青蒿素是从中药青蒿（黄花蒿）中分离得到的具有过氧结构的倍半萜内酯，有很好的抗恶性疟疾活性，其多种衍生物制剂己用于临床。